用异烟肼时合用维生素B₆的目的是
A. 增强疗效
B. 延缓耐药性
C. 中枢抑制
D. 降低对神经的毒性
E. 促进吸收

正确答案：D。降低对神经的毒性